上述疾病中，易出现硬膜下积液的是
A. 结核性脑膜炎
B. 中毒性脑病
C. 病毒性脑病
D. 隐球菌性脑膜炎
E. 化脓性脑膜炎

正确答案：E。化脓性脑膜炎

解析：化脓性脑膜炎（E对）（P239）易出现硬膜下积液，机制尚不完全明确，推测原因：①脑膜炎症时，血管通透性增加，血浆成分渗入，进入硬膜下腔；②脑膜及脑的表面小静脉，尤其穿过硬膜下腔的桥静脉发生炎症栓塞，导致渗出和出血，局部渗透压增高，水分进入硬膜下腔形成硬膜下积液。